由于感染梅毒螺旋体引起的半月形切牙的疾病为
A. 氟斑牙
B. 四环素牙
C. 特纳牙
D. 遗传性乳光牙本质
E. 哈钦森牙

正确答案：E。哈钦森牙

解析：先天性梅毒牙是由于梅毒螺旋体感染牙胚，侵犯成釉器使釉质发育障碍，在恒切牙、第一恒磨牙釉质产生特征性的发育不全改变。病变切牙称哈钦森切牙，切缘中间常有一新月形凹陷或深裂隙。掌握“四环素牙”知识点。